治疗急性湿疹可选用
A. 复方角菜酸酯栓
B. 克霉唑栓
C. 阿达帕林凝胶
D. 复方苯甲酸酊
E. 炉甘石洗剂

正确答案：E。炉甘石洗剂

解析：本题考查炉甘石洗剂。治疗急性湿疹可选用炉甘石洗剂（E对）。急性期无水疱、糜烂、渗出时，建议使用炉甘石洗剂、糖皮质激素乳膏或凝胶；大量渗出时应选择冷湿敷，如3%绷酸溶液、0.1%盐酸小檗碱溶液、0.1%依沙叮唗依沙丫啶溶液等；有糜烂但渗出不多时可用氧化锌油剂。复方角菜酸酯栓（A错）用于治疗痔疮及其他肛门疾患引起的疼痛、肿胀、出血和瘙痒的对症治疗。克霉唑栓（B错）是常用妇科用药，用于念珠菌性外阴阴道病。阿达帕林凝胶（C错）适用于以粉刺、丘疹和脓疱为主要表现的寻常型痤疮的皮肤治疗。复方苯甲酸酊（D错）是外用抗真菌药，治疗浅表真菌感染，对体癣、股癣、手、足癣疗效好。